关于医患关系的表述不正确的是
A. 建立在平等关系上的契约关系
B. 是服务与被服务的契约关系
C. 是有法律保障的信托关系
D. 医患是平等关系
E. 技术关系是建立在利益的基础上

正确答案：E。技术关系是建立在利益的基础上

解析：根据与诊治技术实施有无关系，医患关系可分为技术关系和非技术关系。技术关系是指医患双方围绕着诊断、治疗、护理以及预防、保健、康复等具体医学行为中技术因素所构成的互动关系，是建立在技术因素而不是利益的基础上（E错，为本题正确答案）。由于现实环境的复杂性，仅仅建立在感情基础之上的医患关系很难维持，因此医疗双方形成了建立在平等关系上的契约关系（AD对）。在当代中国，医患关系本质上是在社会地位、人格尊严相互平等前提下的服务与被服务的关系，是服务与被服务的关系的契约关系（B对），是有法律保障的信托关系（C对）。